使用非处方药应注意
A. 严格按照说明书使用
B. 不可超剂量服用
C. 不可盲目长期服用
D. 经常检查药品有效期
E. 妥善保管

正确答案：A、B、C、D、E。严格按照说明书使用；不可超剂量服用；不可盲目长期服用；经常检查药品有效期；妥善保管

解析：本题考查的是非处方药使用注意事项。使用非处方药应注意严格按照说明书使用（A对）、不可超剂量服用（B对）、不可盲目长期服用（C对）、经常检查药品有效期（D对）、妥善保管（E对）。